社会诊断评估的是
A. 需求与健康
B. 健康相关行为
C. 卫生服务
D. 社会环境
E. 以上都不是

正确答案：A。需求与健康